界限性遗忘常见
A. 脑外伤
B. 颅内器质性疾病
C. 精神分裂症
D. 癔症
E. 情感性精神障碍

正确答案：D。癔症

解析：界限性遗忘指对某一特定时间段的经历不能回忆，遗忘的发生通常与该时间段内的不愉快事件有关，多见于癔症（分离（转换）障碍）（D对）。